妇女劳动卫生主要涉及
A. 生殖功能和体力劳动能力
B. 妇女月经功能
C. 妇女生育功能
D. 化学物对新生儿和乳儿的影响
E. 化学物对胚胎和胎儿的影响

正确答案：A。生殖功能和体力劳动能力